根据《药品不良反应报告和监测管理办法》，使用要药品后，导致患者住院时间延长的药品不良反应属于
A. 常见药品不良反应
B. 轻微药品不良反应
C. 新的药品不良反应
D. 严重药品不良反应
E. 药品群体不良事件

正确答案：D。严重药品不良反应

解析：本题考查的是药品不良反应的界定和分类。根据《药品不良反应报告和监测管理办法》，使用要药品后，导致患者住院时间延长的药品不良反应属于严重药品不良反应（D对）。药品不良反应的界定和分类：《药品不良反应报告和监测管理办法》（卫生部令第81号）对药品不良反应及其相关术语作了如下定义。1.药品不良反应：是指合格药品在正常用法用量下出现的与用药目的无关的有害反应。药品不良反应定义表明：①此处的“药品”是合格的人用药品；②药品必须在正常的用法、用量情况下；③人体出现的任何有害的、意外的反应；④某些错误用药、超剂量或滥用药品而导致的不良后果，不应判定为药品不良反应。2.严重药品不良反应：是指因使用药品引起以下损害情形之一的反应：①导致死亡；②危及生命；③致癌、致畸、致出生缺陷；④导致显著的或者永久的人体伤残或者器官功能的损伤；⑤导致住院或者住院时间延长；⑥导致其他重要医学事件，如不进行治疗可能出现上述所列情况的。3.新的药品不良反应（C错）：是指药品说明书中未载明的不良反应。说明书中已有描述，但不良反应发生的性质、程度、后果或者频率与说明书描述不一致或者更严重的，按照新的药品不良反应处理。4.药品群体不良事件（E错）：是指同一药品在使用过程中，在相对集中的时间、区域内，对一定数量人群的身体健康或者生命安全造成损害或者威胁，需要予以紧急处置的事件。药品不良事件不同于药品不良反应，它通常指药品作用于机体，除发挥治疗功效外，有时还会产生某些与药品治疗目的无关的对人体有损害的反应，它不以“合格药品”为前提条件。